某患者，右上6大面积银汞充填，要求修复治疗。检查：（牙合）面大面积银汞充填体，牙冠剩余硬组织少，仅残留颊舌薄壁，无松动，无叩痛，已行完善根管治疗。最佳的治疗方案
A. 嵌体
B. 高嵌体
C. 铸造金属全冠
D. 烤瓷全冠
E. 桩核+全冠

正确答案：E。桩核+全冠

解析：本题考查桩核冠的适应证。题中患牙大面积缺损，剩余牙体组织少，仅颊舌侧两薄壁，牙体组织抗力较弱，且已行完善根管治疗，单纯全冠修复如烤瓷全冠（D错）和铸造金属全冠（C错）会因预备体抗力形差而发生冠折，嵌体（A错）和高嵌体（B错）的固位力不如全冠修复，因此更不能采用嵌体及高嵌体修复。正确修复方法为去除牙冠部分薄弱的牙体组织，进行桩核+全冠修复（E对）。